十二经脉气血循环中三焦经传注的经脉是
A. 手太阴肺经
B. 足少阳胆经
C. 手少阴心经
D. 足太阴脾经
E. 足厥阴肝经

正确答案：B。足少阳胆经

解析：十二经脉的气血流注从肺经开始逐经相传，至肝经而终，再由肝经复传于肺经，流注不已，从而构成了周而复始、如环无端的循环传注系统。其流注次序是手太阴肺经——手阳明大肠经——足阳明胃经——足太阴脾经——手少阴心经——手太阳小肠经——足太阳膀胱经——足少阴肾经——手厥阴心包经——手少阳三焦经——足少阳胆经——足厥阴肝经。可见，十二经脉气血循环中的手少阳三焦经传注的是足少阳胆经（B对）。